以下哪种牙髓疾病患者同时拥有牙髓炎和牙周炎的临床表现
A. 可复性牙髓炎
B. 急性浆液性牙髓炎
C. 慢性化脓性牙髓炎
D. 逆行性牙髓炎
E. 慢性增生型牙髓炎

正确答案：D。逆行性牙髓炎

解析：逆行性牙髓炎的患牙同时具有牙周炎和牙髓炎的临床表现。掌握“残髓炎及逆行性牙髓炎”知识点。